患者，女，67岁，入院后行左侧髋关节置换术，术前12小时皮下注射低分子肝素预防深静脉血栓。术后患者情况稳定，继续使用低分子肝素，住院第7天出院。关于低分子肝素抗凝作用机制的说法，正确的是
A. 能使凝血级联的丝氨酸蛋白酶失活
B. 通过增强抗凝血酶Ⅲ（AT-Ⅲ）的活性，抑制凝血因子Ⅱₐ和Ⅹₐ发挥抗凝作用
C. 体外试验具有直接的抗凝活性，可抑制体外凝血过程
D. 能刺激脂蛋白脂肪酶的释放，加速血液循环中脂蛋白的清除
E. 能直接激活凝血因子

正确答案：B。通过增强抗凝血酶Ⅲ（AT-Ⅲ）的活性，抑制凝血因子Ⅱₐ和Ⅹₐ发挥抗凝作用

解析：本题考查低分子肝素抗凝作用机制。低分子肝素的作用靶点为抗凝血酶Ⅲ（AT-Ⅲ），主要通过抑制因子Ⅱa、Xa发挥抗凝作用（B对）， 且抑制Xa＞Ⅱa。